患者，男，35岁。进食时左侧下颌下腺区肿胀、疼痛，停止进食数小时后，疼痛亦随之消退。检查见左侧导管口黏膜红肿，导管呈条索状，挤压腺体可见少许脓性分泌物自导管口溢出。唾液腺结石病的最典型表现是
A. 炎症症状
B. 全身症状
C. 口干症状
D. 神经症状
E. 阻塞症状

正确答案：E。阻塞症状

解析：基础知识掌握。掌握“涎石病及下颌下腺炎”知识点。